检测水样中“三氮”，在采样前应在采样容器中加入的水质保存剂是
A. H₂SO₄
B. Na₂CO₃
C. NaHCO₃
D. Na₂SO₄
E. NaCl

正确答案：A。H₂SO₄

解析：本题考查水质保存剂。在检测水样中“三氮”时，应该采用H₂SO₄（A对BCDE错）作为水质保存剂，它可以有效地抑制水样中氮组分的氧化降解，从而保证检测结果的准确性。